男，8岁。因有胫骨平台骨折术后染1月余入院治疗。骨科主治医师王来建议进行专家会诊。会诊后决定采用保守治疗，既避免手术治疗造成软组织的进一步损伤，又能节约费用。治疗期间患者经常出现紧张、焦虑,害怕出现组织坏死甚至截肢等严重后果，影响睡眠和康复。骨科主治医师应当对患者实施的医学措施是
A. 精神障碍治疗
B. 心理健康指导
C. 精神障碍鉴定
D. 精神障碍诊断
E. 精神障碍检查

正确答案：B。心理健康指导

解析：男，8岁。因有胫骨平台骨折术后染1月余入院治疗。骨科主治医师王来建议进行专家会诊。会诊后决定采用保守治疗，既避免手术治疗造成软组织的进一步损伤，又能节约费用。治疗期间患者经常出现紧张、焦虑，害怕出现组织坏死甚至截肢等严重后果，影响睡眠和康复。骨科主治医师应当对患者实施的医学措施是心理健康指导（B错）。根据题目中的信息治疗期间患者经常出现紧张、焦虑，害怕出现组织坏死甚至截肢等严重后果，影响睡眠和康复，所以骨科主治医师应当对患者实施的医学措施是心理健康指导。精神障碍指的是大脑机能活动发生紊乱，导致认知、情感、行为和意志等精神活动不同程度障碍的总称；许多精神障碍患者有妄想、幻觉、错觉、情感障碍、哭笑无常、自言自语、行为怪异、意志减退，绝大多数病人缺乏自知力，不承认自己有病，不主动寻求医生的帮助。所以该患者无精神障碍，骨科主治医师不必对其进行精神障碍治疗（A错）、鉴定（C错）、诊断（D错）和检查（E错）。